青少年牙周炎初期患者的自觉症状常为
A. 牙齿咀嚼无力
B. 牙龈明显出血
C. 牙龈明显红肿
D. 口臭
E. 牙周袋溢脓

正确答案：A。牙齿咀嚼无力

解析：本题考查局限型侵袭性牙周炎的临床表现。青少年牙周炎初期患者的自觉症状常为牙齿咀嚼无力（A对）。青少年牙周炎现在称为局限性侵袭性牙周炎，该病的突出表现为菌斑、牙石量很少，牙龈表面炎症轻微，但却已有深牙周袋和牙槽骨破坏，因此患者初期就会出现牙齿松动和移位，自觉牙齿咀嚼无力。初期牙龈炎症轻微，所以牙龈不会有明显出血（B错）或红肿（C错）；到晚期则会形成牙周脓肿，出现牙周袋溢脓（E错）、口臭（D错），但患者口腔菌斑牙石量少，早期炎症轻微，也无脓肿，因此不会出现溢脓、口臭。